将某人群内患有某病的人与同样人群内未患该病的人作为研究对象，调查他们对某个或某些可疑病因的暴露有无和暴露程度，通过比较两组的暴露史来评价暴露与疾病的关系，这种方法是
A. 生态学研究
B. 病例对照研究
C. 队列研究
D. 历史性队列研究
E. 筛查

正确答案：B。病例对照研究

解析：本题考查病例对照研究的概念。病例对照研究（B对ACDE错）是以当前已经确诊的患有某特定疾病的一组病人作为病例组，以不患有该病但具有可比性的一组个体作为对照组，通过询间、实验室检查或复查病史，搜集研究对象既往对各种可能的危险因素的暴露史，测量并采用统计学检验，比较病例组与对照组各因素暴露比例的差异是否具有统计学意义，然后评估各种偏倚对研究结果的影响，并借助病因推断技术，判断某个或某些暴露因素是否为疾病的危险因素，从而达到探索和检验病因假说的目的。